关于处方药和非处方药分类管理的说法，正确的是
A. 药品零售企业禁止经营肽类激素
B. 红色标识用于甲类非处方药和用作指南性标志
C. 处方药和甲类非处方药不得在大众媒介上发布广告
D. 中西药复方制剂不得作为乙类非处方药

正确答案：D。中西药复方制剂不得作为乙类非处方药

解析：本题考查的是乙类非处方药的确定。关于处方药和非处方药分类管理的说法，正确的是中西药复方制剂不得作为乙类非处方药（D对）。以下情况下不应作为乙类非处方药：儿童用药（有儿童用法用量的均包括在内，维生素、矿物质类除外）；化学药品含抗菌药物、激素等成分的；中成药含毒性药材（包括大毒和有毒）和重金属的口服制剂、含大毒药材的外用制剂；严重不良反应发生率达万分之一以上；中成药组方中包括无国家或省级药品标准药材的（药食同源的除外）；中西药复方制剂；辅助用药。严禁药品零售企业销售胰岛素以外的蛋白同化制剂或其他肽类激素（A错）。非处方药专有标识图案分为红色和绿色，红色专有标识用于甲类非处方药品（B错），绿色专有标识用于乙类非处方药品和用作指南性标志。非处方药的广告管理：非处方药是方便个人消费者自我保健、治疗的药品，消费者应详细了解其治疗功效。因此，非处方药可以在大众媒介上进行广告宣传（C错），但广告内容必须经过审查、批准，不能任意夸大或擅自篡改。其目的是正确引导个人消费者科学、合理地进行自我药疗。